限制髋关节后伸的主要韧带是
A. 坐股韧带
B. 髂股韧带
C. 耻股韧带
D. 腹股沟韧带
E. 股骨头韧带

正确答案：B。髂股韧带

解析：限制髋关节过度后伸的韧带是髂骨韧带（B对），坐骨韧带（A错）限制髋关节旋内，耻骨韧带（C错）限制髋关节外展和旋外。